谷精草除明目退翳外，又能
A. 疏散风热
B. 散结消肿
C. 润肠通便
D. 利尿通淋
E. 消肿排脓

正确答案：A。疏散风热

解析：本题考查的是谷精草的功效。谷精草除明目退翳外，又能疏散风热（A对）。谷精草：【功效】疏散风热，明目退翳。夏枯草：【功效】清肝明目，散结消肿（B错）。决明子：【功效】清肝明目，润肠通便（C错）。鱼腥草：【功效】清热解毒，排脓消痈，利尿通淋（D错）。天花粉：【功效】清热生津，清肺润燥，消肿排脓（E错）。